下列药品中，属于酰胺类的脑功能改善及抗记忆障碍药是
A. 吡拉西坦
B. 胞磷胆碱
C. 利斯的明
D. 多奈哌齐
E. 石杉碱甲

正确答案：A。吡拉西坦

解析：本题考查酰胺类的脑功能改善及抗记忆障碍药。下列药品中，属于酰胺类的脑功能改善及抗记忆障碍药是吡拉西坦（A对）。目前，临床用于脑功能改善及抗记忆障碍药，按其作用机制可分为：酰胺类中枢兴奋药、乙酰胆碱酯酶抑制剂和其他类。酰胺类中枢兴奋药：代表药有吡拉西坦、茴拉西坦、奥拉西坦。乙酰胆碱酯酶抑制剂：代表药有石杉碱甲（E错）、多奈哌齐（D错）、利斯的明（C错）（卡巴拉汀）、加兰他敏。其他类：有胞磷胆碱钠（B错）、艾地苯醌、银杏叶提取物等。